Thomas征阳性提示
A. 骶髂关节炎
B. 膝关节屈曲挛缩
C. 腰椎间盘突出症
D. 髋关节屈曲挛缩
E. 腰椎管狭窄

正确答案：D。髋关节屈曲挛缩

解析：Thmoas征又称髋关节屈曲挛缩试验，检查阳性说明患髋存在屈曲挛缩畸形（D对）（P758）。骶髂关节炎（A错）是以骨质硬化为特点的非特异性炎症，常见症状为疼痛、晨僵、关节挛缩、功能紊乱、静息痛、负重时疼痛加重，不出现Thmoas征阳性。膝关节屈曲挛缩（B错）可见于类风湿关节炎、膝关节结核等疾病的膝关节畸形，Thmoas征不用于此项检查。腰椎间盘突出症（C错）可出现直腿抬高试验及加强试验阳性（P731）。腰椎管狭窄（E错）是指多种原因所致椎管、神经根管、椎间孔狭窄，并使相应部位的脊髓、马尾神经或神经根受压的病变，临床上以下腰痛、马尾神经或腰神经受压症状为主要表现，以神经源性间歇性跛行为主要特点，主诉症状多而阳性体征少（P734）。